心肺复苏时首选药物是
A. 肾上腺素
B. 去甲肾上腺素
C. 阿托品
D. 异丙肾腺素
E. 多巴胺

正确答案：A。肾上腺素

解析：肾上腺素（A对）是α、β肾上腺素受体激动药，使心肌收缩力增强、增加心脑灌注量、可帮助自主心律恢复，有利于恢复心肺功能，是心肺复苏的首选药物。去甲肾上腺素（B错）为α受体肾上腺素受体激动药，仅用于早期神经源性休克以及嗜铬细胞瘤切除后或药物中毒时的低血压。阿托品（C错）是M胆碱受体阻断药，主要用于解除平滑痉挛和抑制腺体分泌。异丙肾上腺素（D错）为β肾上腺素受体激动药，常用于心室自身节律缓慢、高度房室传导阻滞或窦房结功能衰竭而并发的心脏停搏，以及房室传导阻滞和支气管哮喘的治疗。